白豆蔻、肉豆蔻的共同功效是
A. 温中行气
B. 涩肠止泻
C. 化湿行气
D. 温中止呕
E. 温肾助阳

正确答案：A。温中行气

解析：该题考查白豆蔻与肉豆蔻的功效。豆蔻又称白豆蔻，与肉豆蔻名虽相近，但功效差别较大。白豆蔻为化湿药，肉豆蔻为敛肺涩肠药。两者均可温中行气（A对），涩肠止泻为肉豆蔻的功效（B错），化湿行气为白豆蔻的功效（C错），温中止呕为白豆蔻功效（D错），两者均不能温肾助阳（E错）。